男孩，6岁。因发热2周，头痛伴呕吐3天，惊厥1次入院。疑诊结核性脑膜炎。入院次日，患者突然心率增快，呼吸节律不整，双瞳孔不等大。错误的处理是
A. 腰椎穿刺减压
B. 甘露醇静滴
C. 糖皮质激素静注
D. 侧脑室引流
E. 利尿剂静注

正确答案：A。腰椎穿刺减压

解析：疑诊结核性脑膜炎患者，突然心率增快，呼吸节律不整，双瞳孔不等大，这种临床症状出现的原因是持续的颅内高压引发了脑疝，假如此时采取腰椎穿刺减压会加重脑疝、突然死亡（A错，为本题正确答案）。甘露醇静滴（B对）、糖皮质激素静注（C对）、侧脑室引流（D对）、利尿剂静注（E对）都可以用作脑疝的抢救措施。